量效曲线说明量效关系存在的规律有
A. 药物达到一定的剂量才能产生效应
B. 在一定范围内，剂量增加效应也增强
C. 药物效应的增强并不是无限制的
D. 药物量效曲线的对称点应在效应的50%处
E. 药物在体内的表观分布容积

正确答案：A、B、C、D。药物达到一定的剂量才能产生效应；在一定范围内，剂量增加效应也增强；药物效应的增强并不是无限制的；药物量效曲线的对称点应在效应的50%处

解析：本题考查药物的量效关系。量效曲线说明量效关系存在的规律有：药物达到一定的剂量（最小有效量）才能产生效应（A对）。在一定范围内，剂量增加效应也增强（B对）。药物效应的增强并不是无限制的（C对）。药物量效曲线的对称点应在效应的50%处（D对）。药时曲线可看出药物在体内的表观分布容积（E错）。